溶剂法分离麻黄碱和伪麻黄碱依据的原理是
A. 二者草酸盐溶解度的差别
B. 二者硝酸盐溶解度的差别
C. 二者旋光度的差别
D. 二者晶型的差别
E. 二者极性的差别

正确答案：A。二者草酸盐溶解度的差别

解析：本题考查生物碱的分离方法。溶剂法分离麻黄碱和伪麻黄碱依据的原理是二者草酸盐溶解度的差别（A错）。生物碱与不同酸生成的盐溶解性可能不同，也可以利用这种差异来分离生物碱或其盐。如用溶剂法从麻黄中提取分离麻黄碱、伪麻黄碱，即利用二者草酸盐的水溶性不同。基于生物碱或生物碱盐溶解度差异（B错）的分离方法：总生物碱中各单体的极性（E错）不同，对有机溶剂的溶解度可能有差异，可利用这种差异来分离生物碱。如苦参中苦参碱和氧化苦参碱的分离。